患者初病表现为手足不温，身易恶寒，指尖发青，继而发展为面色苍白，唇甲色淡，小腹冷痛，手足冷凉，脉细欲厥治用
A. 当归四逆汤
B. 通脉四逆汤
C. 通脉四逆加猪胆汁汤
D. 四逆加人参汤
E. 白通汤

正确答案：A。当归四逆汤

解析：手足厥寒，当察气血阴阳，辨其寒热虚实。四肢逆冷，脉微欲绝，属少阴阳衰、阴寒内盛之寒厥证。今手足厥寒，面色苍白，唇甲色淡，小腹冷痛，手足冷凉，即本证厥逆的程度较寒厥证的四肢逆冷为轻。脉细欲绝与脉微欲绝有别，细主血虚，微主阳虚。本证手足厥寒与脉细欲绝并见，是血虚感寒，寒凝经脉，气血运行不畅，四末失于温养所致，故治以当归四逆汤养血通脉，通经散寒（A对）。